低渗性脱水患者可表现有
A. 尿少
B. 低容量性休克
C. 两者均有
D. 两者均无
E. 无

正确答案：C。两者均有

解析：低渗性脱水特点是失Na＋多于失水，由于循环血量减少可使ADH释放增多，肾小管重吸收水增多引起尿少（A对），细胞外液的水向渗透压相对高的细胞内转移，加重细胞外液水的丢失而易发生低容量性休克（B对，故C为本题正确答案）。